重症肌无力的病变部位在
A. 周围神经
B. 横纹肌
C. 脊髓前角细胞
D. 神经肌肉接头处
E. 大脑皮层运动区

正确答案：D。神经肌肉接头处

解析：重症肌无力是一种主要累及神经-肌肉接头（D对）突触后膜AChR的自身免疫性疾病，主要由AChR抗体介导，在细胞免疫和补体参与下突触后膜AChR被大量破坏，不能产生足够的终板电位，导致突触后膜传递功能障碍而发生肌无力。周围神经（A错）病变主要见于三叉神经痛、特发性面神经麻痹和多发性神经病。横纹肌（骨骼肌）（B错）病变主要见于周期性瘫痪。脊髓前角细胞（C错）病变主要见于脊髓灰质炎、流行性乙型脑脊髓炎、脊髓前动脉综合征（P321）。大脑皮层运动区（E错）病变可见于多种疾病，主要表现为上运动神经元性瘫痪（痉挛性瘫痪）（P81）。